片剂中的薄膜衣材料是
A. 山梨酸
B. 羟丙基甲基纤维素
C. 甲基纤维素
D. 微粉硅胶
E. 聚乙二醇400

正确答案：B。羟丙基甲基纤维素

解析：本题考查片剂的包衣。羟丙基甲基纤维素（B对）属于片剂中的薄膜衣材料。山梨酸（A错）为防腐剂；甲基纤维素（C错）可作为水溶性软膏的基质组成成分；微粉硅胶（D错）为助流剂；聚乙二醇400（E错）可作溶剂、助溶剂。